不是化石燃料完全燃烧的产物的是
A. 二氧化碳
B. 二氧化硫
C. 多环芳烃
D. 二氧化氮
E. 灰分

正确答案：C。多环芳烃

解析：本题考查化石燃料完全燃烧的产物。二氧化碳（A对）、二氧化硫（B对）、二氧化氮（D对）、灰分（E对）均是化石燃料完全燃烧的产物。多环芳烃（C错，为本题正确答案）主要来源于各种含碳有机物的热解和不完全燃烧，如煤、木柴、烟叶和石油产品的燃烧，烹调油烟以及各种有机废物的焚烧等。